以下情况最常于听诊时发现心律不齐的是
A. 室性心动过速
B. 室上性心动过速
C. 室性期前收缩
D. 三度房室传导阻滞
E. 窦性心动过速

正确答案：C。室性期前收缩

解析：室性期前收缩是由希氏束分支以下异位起搏点提前产生的心室激动，中、老年人多见，听诊时可听到突然提前出现心搏，第一心音较正常响亮，第二心音微弱或听不到，随后有较长的代偿间歇，室性期前收缩是最常见的心律失常。由于心室提前激动，室性期前收缩（C对）在听诊时常表现为心律不齐。室性心动过速（P198）（A错）是起源于希氏束分支以下的的特殊传导系统或者心室肌的连续3个或以上的异位心搏，听诊心律轻度不规则。室上性心动过速（P192）（B错）体检心尖区第一心音强度恒定，心律绝对规则。三度房室传导阻滞（P203）（D错）典型表现为心房和心室活动各自独立、互不相关，心律一般规整。窦性心动过速（P182）（E错）是指成人窦性心律超过100次/分，不会出现心律不齐。